竞争免疫法测糖化血红蛋白的标准
A. 3.8-6.8%
B. 4.8-6.0%
C. 3.8-7.8%
D. 4.8-7.0%
E. 5.0-7.0%

正确答案：B。4.8-6.0%

解析：本题考查的是糖化血红蛋白的标准。竞争免疫法测糖化血红蛋白的标准4.8-6.0%（B对）。糖化血红蛋白红细胞生存期间血红蛋白与己糖缓慢、连续的非酶促反应产物。参考值4% ～6%。